男性，35岁，半年来逐渐贫血，不发热，无出血症状，晨起排尿呈浓茶色，巩膜轻度黄疸，肝脾不肿大，血红蛋白82g/L，白细胞5.6×10⁹/L，血小板93×10⁹/L，网织红细胞5%，为确诊首选哪项检查
A. 骨髓穿刺
B. 血清铁
C. 尿含铁血黄素
D. 抗人球蛋白试验
E. 酸化血清溶血试验

正确答案：E。酸化血清溶血试验

解析：中年男性患者，半年来逐渐贫血，不发热，无出血症状，晨起排尿呈浓茶色（阵发性血红蛋白尿的特征性表现），巩膜轻度黄疸，肝脾不肿大（提示血管内溶血），血红蛋白82g/L（成年男性的正常值为120～160g/L，血红蛋白减低），白细胞5.6×10⁹/L（正常值为4～10×10⁹/L），血小板93×10⁹/L（正常值为100～300×10⁹/L，血小板减低），网织红细胞5%（正常值为0.5%～5%），根据患者的临床症状、体征及实验室检查，最可能的诊断阵发性血红蛋白尿（PNH），为进一步明确诊断应首选酸化血清溶血试验（E对），其为PNH的诊断性试验之一。骨髓穿刺（A错）是采集骨髓液的一种常用诊断技术，临床上骨髓穿刺液常用于血细胞形态学检查，也可用于造血干细胞培养、细胞遗传学分析及病原生物学检查等，以协助临床诊断、观察疗效和判断预后等。血清铁（B错）即与转铁蛋白结合的铁，其含量不仅取决于血清中铁的含量，还受转铁蛋白的影响，血清铁检测的适应证：①转铁蛋白测定的参数，②铁吸收实验参数，③急性铁中毒。尿含铁血黄素（C错）慢性血管内溶血可呈现阳性，并待续数周，常见于阵发性睡眠性血红蛋白尿症，在溶血初期可阴性。抗人球蛋白试验（D错）见于新生儿溶血病、自身免疫性溶血性贫血、系统性红斑狼疮 （SLE）、类风湿关节炎、一些淋巴瘤、甲基巴多及青霉素型等药物性溶血反应。